含氮有机物氧化分解的最终产物是
A. 有机氮
B. 蛋白氮
C. 氨氮
D. 亚硝酸盐氮
E. 硝酸盐氮

正确答案：E。硝酸盐氮

解析：本题考查含氮化合物。含氮化合物包括有机氮、蛋白氮、氨氮、亚硝酸盐氮和硝酸盐氮。含氮有机物氧化分解的最终产物是硝酸盐氮（E对ABCD错）。